沉降性颗粒物的粒径一般为
A. 5～10μm
B. ＞10～50μm
C. ＞50～75μm
D. ＞75～100μm
E. ＞100μm

正确答案：E。＞100μm

解析：本题考查沉降性颗粒物的粒径。沉降性颗粒物是指具有自身重量的颗粒物，其粒径一般大于100μm（E对ABCD错）。